关于牙周病患者的全身病史，哪一项不准确
A. 牙周治疗必须在全身疾病控制下才能进行
B. 有助于牙周病病因的全面分析
C. 全身疾病改变对治疗的反应
D. 提醒医生对特殊病人采取特殊治疗
E. 全身疾病改变牙周组织对局部刺激的反应

正确答案：A。牙周治疗必须在全身疾病控制下才能进行

解析：本题考查牙周病与全身健康的关系。牙周病患者的全身病史不准确的是牙周治疗必须在全身疾病控制下才能进行（A错，为本题的正确答案）。牙周病与全身健康是双向的关系：1.某些全身疾病可能影响或加快牙周病的发生和发展，成为牙周病是全身危险因素，所以了解全身病史有助于牙周病病因的全面分析（B对）。对一些全身疾病，如糖尿病.风湿性心脏病.肾病等，应该在病情得到控制下进行牙周治疗，否则可能会继发感染，甚至导致死亡，这也提醒医生对特殊病人采取特殊治疗（D对），如预防性使用抗生素，以防止暂时性菌血症，手术操作轻柔以减少创面和创伤。一些全身疾病会改变对治疗的反应（C对），如糖尿病患者单纯牙周洁治就不能获得很好的效果，也会改变局部刺激的反应（E对），牙周组织是一些性激素的靶器官，当内分泌功能紊乱，如性激素水平提高，会使牙龈组织对菌斑生物膜等局部刺激物的反应性增强。2.牙周健康也可能影响全身健康和疾病，牙周感染可能是心脑血管疾病、妊娠并发症、呼吸道感染等疾病的危险因素，此时的牙周治疗有利于全身疾病的治疗和控制，而不是必须在全身疾病控制下才能进行。